下列哪项不是哮喘缓解期肾气虚弱证的特征
A. 神疲乏力
B. 形寒肢冷
C. 舌红苔黄腻
D. 遗尿或夜尿增多
E. 腰膝酸软

正确答案：C。舌红苔黄腻

解析：哮喘缓解期肾气虚弱，摄纳失常，劳则气耗，气不归元，故可致动则气短（A错）。肾虚无力温养形体，可致形寒肢冷（B错）。肾气虚，膀胱开阖失司，可致遗尿或夜尿（D错）。肾虚腰府失养，可致腰膝酸软（E错）。舌红苔黄腻一般为湿热内蕴的表现（C对）。